迅速、可逆性地抑制血小板二磷酸腺苷P2Y12受体的药物是
A. 替格瑞洛
B. 华法林
C. 利伐沙班
D. 达比加群酯
E. 替罗非班

正确答案：A。替格瑞洛

解析：本题考查药物作用机制及分类。替格瑞洛（A对）能够迅速、可逆性地抑制血小板二磷酸腺苷P2Y12受体，阻断信号传导和血小板活化。华法林（B错）能够抑制肝细胞中凝血因子的合成，具有抗凝和抗血小板聚集功能。利伐沙班（C错）可直接抑制Xa因子，阻断凝血酶原转化为凝血酶，但不影响已形成的凝血酶活性。达比加群酯（D错）为直接凝血酶抑制剂(DTIs)，用于预防非瓣膜性房颤患者的卒中和全身性栓塞。替罗非班（E错）是一种非肽类的血小板糖蛋白Ⅱb/Ⅲa受体的可逆性拮抗剂，能够阻断血小板的交联及血小板的聚集。